《麻醉品管理办法》属于
A. 法律
B. 行政法规
C. 地方性法规
D. 部门规章
E. 其他规范性文件

正确答案：B。行政法规

解析：本题考查行政法规。《麻醉品管理办法》属于行政法规（B对）。国务院制定、发布的药品管理行政法规主要有10部，包括《药品管理法实施条例》《中药品种保护条例》《戒毒条例》《易制毒化学品管理条例》《麻醉药品和精神药品管理条例》《反兴奋剂条例》《血液制品管理条例》《医疗用毒性药品管理办法》《放射性药品管理办法》《野生药材资源保护管理条例》等。与药品监督管理职责密切相关的法律（A错）主要有4部，包括《药品管理法》《中华人民共和国疫苗管理法》（以下简称《疫苗管理法》）《基本医疗卫生与健康促进法》《中华人民共和国禁毒法》；与药品管理有关的法律有《中华人民共和国刑法》《中华人民共和国广告法》《中华人民共和国价格法》《中华人民共和国消费者权益保护法》《中华人民共和国反不正当竞争法》《中华人民共和国专利法》等。地方性法规（C错）是根据本行政区域的实际需要，依法制定的在本行政区域内具有法律效力的规范性文件。部门规章（D错）指具有行政管理职能的直属机构在本部门的权限范围内制定规章。规范性文件（E错）一般是指属于法律范畴的立法性文件和除此以外的由国家机关和其他团体、组织制定的具有约束力的非立法性文件的总和。